根据牙在骨内的深度，完全的骨埋伏阻生称为
A. 第Ⅱ类阻生
B. 第Ⅲ类阻生
C. 中位阻生
D. 低位阻生
E. 近中阻生

正确答案：D。低位阻生

解析：本题考查阻生牙的类型。根据牙在骨内的深度，完全的骨埋伏阻生称为低位阻生（D对）。1.根据牙在颌骨内的深度，分为高位、中位、低位阻生：高位阻生指牙的最高部位平行或高于牙弓平面；中位阻生（C错）指牙的最高部位低于平面，但高于第二磨牙的牙颈部；完全的骨埋伏阻生称为低位阻生，一般指牙的最高部位低于第二磨牙的牙颈部。2.根据牙与下颌升支及第二磨牙的关系，分为Ⅰ类、Ⅱ类、Ⅲ类3类：Ⅰ类阻生指下颌升支及第二磨牙远中面之间有足够间隙容纳第三磨牙牙冠的近远中径；Ⅱ类阻生是指下颌支前缘与第二磨牙远中面之间的间隙不大，不能容纳第三磨牙的近远中径（A错）；Ⅲ类阻生是指第三磨牙的全部或大部分位于下颌支内（B错）。Winter根据阻生智牙的长轴与第二磨牙长轴的关系可分成垂直阻生、水平阻生、近中阻生、远中阻生、颊向阻生、舌向阻生、倒置阻生。近中阻生即智齿牙冠靠近第二磨牙，牙根远离第二磨牙（E错）。